医学道德修养是指医务人员在医学道德方面所进行的自我教育、自我锻炼和自我陶冶，以及在此基础上迖到的
A. 医疗实践能力
B. 医学道德境界
C. 医疗技术水平
D. 医患沟通能力
E. 医疗道德意识

正确答案：B。医学道德境界

解析：医学道德修养是指医务人员在医学道德方面所进行的自我教育、自我锻炼和自我陶冶，以及在此基础上迖到的医学道德境界。掌握“医学道德修养”知识点。